鱼类早期腐败的鉴定可以用
A. K值
B. 三甲胺
C. pH
D. 组胺
E. 挥发性盐基总氮

正确答案：A。K值

解析：本题考查鉴定鱼类早期腐败的指标。K值（A对BCDE错）是指ATP分解的低级产物肌苷和次黄嘌呤占ATP系列分解产物的百分比，主要适用于鉴定鱼类早期腐败。若K≤20%，说明鱼体绝对新鲜；K≥40%，说明鱼体开始有腐败迹象。